根据《关于进一步改革完善药品生产流通使用政策的若干意见》，属于药品流通环节重大改革政策的有
A. 严厉打击租借证照、非法渠道购销药品、虚开发票等违法违规行为
B. 落实药品分类采购政策，降低药品虚高价格
C. 全面推行以按病种付费为主，按人头付费方式为补充的复合型付费方式
D. 推进零售药店分级分类管理，提高零售连锁率

正确答案：A、B、D。严厉打击租借证照、非法渠道购销药品、虚开发票等违法违规行为；落实药品分类采购政策，降低药品虚高价格；推进零售药店分级分类管理，提高零售连锁率

解析：本题考查的是药品流通政策与改革措施。药品流通政策与改革措施：流通环节重点是整顿流通秩序，推进药品流通体制改革。①推动药品流通企业转型升级，健全城乡药品流通网络。推进零售药店分级分类管理，提高零售连锁率（D对）。②推行药品购销“两票制”综合医改试点省（区、市）和公立医院改革试点城市要率先推行两票制，鼓励其他地区实行两票制，争取到2018年在全国推行。③落实药品分类采购政策，降低药品虚高价格（B对）。④加强药品购销合同管理，违法合同约定要承当相应的处罚。⑤整治药品流通领域突出问题，严厉打击租借证照、虚假交易、伪造记录、非法渠道购销药品、商业贿赂、价格欺诈、价格垄断以及伪造、虚开发票等违法违规行为（A对），依法严肃惩处违法违规企业和医疗机构，严肃追究相关负责人的责任，并记入不良信用记录，涉嫌犯罪的，及时移送司法机关处理。⑥建立药品价格信息可追溯机制，促进价格信息透明。⑦积极发挥“互联网+药品流通”的优势和作用，方便群众用药。规范零售药店互联网零售服务，推广“网订店取”“网订店送”等新型配送方式。鼓励有条件的地区依托现有信息系统，开展药师网上处方审核、合理用药指导等药事服务。全面推行以按病种付费为主，按人头付费方式为补充的复合型付费方式（C错）是使用环节的重大改革政策。